某冠心病患者，使用中等强度的他汀类药物治疗6个月后，低密度脂蛋白胆固醇仍不达标，每日调脂治疗方案可调整为
A. 氟伐他汀20～40mg
B. 辛伐他汀20～40mg
C. 阿托伐他汀10～20mg
D. 瑞舒伐他汀20～40mg
E. 匹伐他汀20～40mg

正确答案：D。瑞舒伐他汀20～40mg

解析：本题考查调节血脂药的作用特点。使用中等强度的他汀类药物治疗6个月后低密度脂蛋白胆固醇不达标，应调整为高强度的治疗方案，可使用阿托伐他汀40～80mg或瑞舒伐他汀20～40mg（Ｄ对）。